患者右上侧切牙缺失，间隙小，尖牙根长大，但尖牙牙冠少量缺损，前牙浅覆（牙合）、浅覆盖，最好的设计是
A. 单端固定桥
B. 双端固定桥
C. 半固定桥
D. 种植义齿
E. 可摘局部义齿

正确答案：A。单端固定桥

解析：单端固定桥受力后，桥体处形成力臂，基牙根部形成旋转中心，产生杠杆作用，使基牙产生倾斜、扭转，从而引起牙周组织的创伤性损害或固位体松脱。临床上应严格选择病例，如缺牙间隙小，承受（牙合）力不大，而基牙又有足够的支持力和固位力，桥体设计合理，仍可采用。掌握“固定桥的组成和分类”知识点。